某男，30岁。患流感初起，症见发热恶寒、无汗、头痛、鼻塞、喷嚏、咽痒咳嗽、四肢酸痛，治当发散风寒、解热止痛，宜选用的成药是
A. 羚羊感冒胶囊
B. 正柴胡饮颗粒
C. 表实感冒颗粒
D. 感冒清热颗粒
E. 双黄连合剂

正确答案：B。正柴胡饮颗粒

解析：本题考查的是正柴胡饮颗粒的功能。患流感初起，症见发热恶寒、无汗、头痛、鼻塞、喷嚏、咽痒咳嗽、四肢酸痛，治当发散风寒、解热止痛，宜选用的成药是正柴胡饮颗粒（B对）。正柴胡饮颗粒：【功能】发散风寒，解热止痛。羚羊感冒胶囊（A错）：【功能】清热解表。表实感冒颗粒（C错）：【功能】发汗解表，祛风散寒。感冒清热颗粒（D错）：【功能】疏风散寒，解表清热。双黄连合剂（E错）：【功能】疏风解表，清热解毒。